左心衰竭的主要表现是
A. 肺水肿
B. 肝肿大压痛
C. 两者均有
D. 两者均无
E. 无

正确答案：A。肺水肿

解析：左心衰竭时，左心室泵血功能减退，导致左心输出量不足，进而使心室收缩后滞留于内的血液增多，心室舒张期充盈压升高，肺循环血液回流受阻，造成肺循环淤血。严重肺淤血时，淤血毛细血管的管壁通透性增大，血浆渗出到肺间质与肺泡引起急性肺水肿（A对）。同理，右心衰竭可引起体循环淤血，肝肿大压痛（B错）是其表现之一。